选择固定桥基牙条件不重要的是
A. 基牙的支持能力
B. 基牙的固位能力
C. 基牙的共同就位道
D. 基牙的牙周组织健康
E. 基牙必须是活髓

正确答案：E。基牙必须是活髓

解析：本题考查选择固定桥基牙的条件。固定桥的基牙最好是健康的活髓牙，但如果牙髓有病变的牙进行了完善的牙髓治疗并经过了一定时间的观察，证明病变已痊愈且不影响固定桥的效果者，也可以选作基牙（E错，为本题的正确答案）。基牙的主要功能是支持固定桥，负担着基牙自身和桥体额外的力，故要求基牙要有足够的支持负重能力（A对）所以基牙的支持能力很重要。同时，固定桥靠固位体固定在基牙的冠或根上才能行使功能，因此要求基牙应该满足固位体的固位形要求，牙冠部或根部提供良好的固位形，所以基牙的固位能力（B对）也很重要。由于固定桥将各基牙连接成一个整体，故各基牙间能够取得共同就位道（C对）很重要。由于基牙要承担自身的和桥体的（牙合）力，所以基牙牙周组织健康很重要（D对）。